患者，男，6岁，BMI18kg/m²，体检查血常规示血红蛋白94g/L。口服铁剂治疗3个月后，复查血红蛋白升至113g/L，血清铁蛋白14㎍/L（低于正常参考值下限）。下列治疗方案不适宜的是
A. 多食富含铁和蛋白质的食物
B. 继续补充铁剂4～6个月
C. 可加用肠内营养粉剂
D. 加用抑酸药，以促进铁的吸收
E. 血清铁蛋白升至30～50㎍/L可停用铁剂

正确答案：D。加用抑酸药，以促进铁的吸收

解析：本题考查缺铁性贫血的患者教育。注意铁剂与其他药物之间的相互作用：抑酸药物（质子泵抑制剂、H₂受体阻断剂）影响三价铁转化为二价铁，避免长期服用（D错，为本题正确答案）。除补铁外，合理膳食同样重要，宜多食含铁丰富的食物如猪肝、黄豆、蔬菜、水果、大枣、蜂乳、芝麻、黑木耳等。提倡使用铁锅烹任或煮粥，会有助于铁元素的补充。同时注意要有足够蛋白质的摄入（A对）。铁剂治疗有效者，在Hb恢复正常后仍需再补充铁剂4～6个月（B对）以补足储存铁，或在血清铁蛋白升至30～50㎍/L后再停药（E对）。如果治疗4周后Hb较治疗前无改变甚或下降，需要进一步追查原因。